男性，40岁。诉左上颌后牙出现咬合痛7天求治。口腔检查：左上6近远中向纵折，松动Ⅰ°，叩诊（+），牙龈稍红肿。拟局麻下拔除，采用的麻醉方法是
A. 上牙槽后神经阻滞麻醉+眶下神经阻滞麻醉
B. 上牙槽后神经阻滞麻醉+腭前神经阻滞麻醉
C. 上牙槽后神经阻滞麻醉+近中颊根局部浸润麻醉
D. 上牙槽后神经阻滞麻醉+近中颊根局部浸润麻醉+眶下神经阻滞麻醉
E. 上牙槽后神经阻滞麻醉+近中颊根局部浸润麻醉+腭前神经阻滞麻醉

正确答案：E。上牙槽后神经阻滞麻醉+近中颊根局部浸润麻醉+腭前神经阻滞麻醉

解析：本题考查上颌第一磨牙拔除时采用的麻醉方法。上颌第一磨牙由上牙槽后神经（支配第一磨牙的远中颊根和此处软组织）、上牙槽中神经（支配第一磨牙的近中颊根和此处软组织）、腭前神经（支配第一磨牙的腭侧根和腭侧软组织），所以麻醉时应行上牙槽后神经阻滞麻醉，近中颊根局部浸润麻醉以及腭前神经阻滞麻醉（E对BC错）。眶下神经阻滞麻醉（AD错）适用于同侧上颌切牙至前磨牙的拔除。